下列关于全球伤害的流行特征，叙述错误的是
A. 发展中国家的伤害死亡率髙于发达国家
B. 伤害的发生有年龄依赖性
C. 0～14岁的儿童期，伤害死亡率变化规律呈现反向趋势
D. 从全球范围来看，早亡所致生命年损失率呈现上升趋势
E. 从全球范围来看，伤残所致生命年损失率呈现下降趋势

正确答案：D。从全球范围来看，早亡所致生命年损失率呈现上升趋势